色谱法的系统适用性试验内容包括
A. 理论塔板数
B. 重复性
C. 拖尾因子
D. 分离度
E. 保留值

正确答案：A、B、C、D。理论塔板数；重复性；拖尾因子；分离度